不以治疗疾病为目的，但具有调节机体功能，用于特定人群食用的是
A. 保健食品
B. 医疗器械
C. 化妆品
D. 药品

正确答案：A。保健食品

解析：本题考查保健食品的界定。不以治疗疾病为目的，但具有调节机体功能，用于特定人群食用的是保健食品（A对）。保健食品是指声称具有特定保健功能或者以补充维生素、矿物质为目的的食品。即适宜于特定人群食用，具有调节机体功能，不以治疗疾病为目的，并且对人体不产生任何急性、亚急性或者慢性危害的食品。医疗器械（B错），是指直接或者间接用于人体的仪器、设备、器具、体外诊断试剂及校准物、材料以及其他类似或者相关的物品，包括所需要的计算机软件。化妆品（C错），是指以涂擦、喷洒或其他类似的方式，施用于皮肤、毛发、指甲、口唇等人体表面，以清洁、保护、美化、修饰为目的的日用化学工业产品。《药品管理法》规定，药品（D错）是指“用于预防、治疗、诊断人的疾病，有目的地调节人的生理机能并规定有适应症或者功能主治、用法和用量的物质，包括中药、化学药和生物制品等”。